不属于精神分裂症的阳性症状的是
A. 联想散漫
B. 妄想
C. 幻觉
D. 注意力不集中
E. 行为紊乱

正确答案：D。注意力不集中

解析：精神分裂症患者可表现出一系列较高级的认知功能缺陷，包括注意力不集中、抽象概括和创造力等方面，注意力不集中为精神分裂症的症状之一但不是阳性症状（D错，为本题正确答案）。精神分裂症的阳性症状包括：联想散漫（瓦解症状群中的思维形式障碍）（A对）、妄想（B对）、幻觉（C对）、及言语和行为紊乱（E对）。